男，50岁。肝炎肝硬化10年，门腔静脉分流术后3年。睡眠倒错、计算能力下降2天。该患者不宜进食的食物种类是
A. 淀粉类食物
B. 高维生素食物
C. 高纤维素食物
D. 低脂饮食
E. 高蛋白饮食

正确答案：E。高蛋白饮食

解析：中老年男性患者，既往有肝炎肝硬化及门腔静脉分流术病史（肝性脑病形成的基础）。睡眠倒错、计算能力下降（肝性脑病高级神经中枢功能紊乱的表现）。综合患者的病史、临床表现，可初步诊断为肝硬化后肝性脑病。氨代谢紊乱引起氨中毒是肝性脑病、特别是门-体分流性肝性脑病的重要发病机制。高蛋白饮食（E错，为本题正确答案）时，蛋白质经肠道细菌的分解作用会产生大量的氨，加重肝性脑病。淀粉类食物（A对）为肝性脑病病人主要的能量供应；高维生素食物（B对）有利于机体正常生理功能的进行，均不会导致血氨增加，可以进食。高纤维素食物（C对）可以防治便秘（肝性脑病的诱因）、清洁肠道；低脂饮食（D对）可减轻肝脏负担；